关于Palmer记录系统的说法错误的是
A. 其分区方法与部位记录法的方式相同
B. 恒牙记录方法与部位记录法相同
C. 乳牙记录方法与部位记录法相同
D. 乳牙则是用大写英文字母A～E表示
E. 恒牙记录使用阿拉伯数字1～8表示

正确答案：C。乳牙记录方法与部位记录法相同

解析：Palmer记录系统：其分区方法、恒牙记录方法与部位记录方法相同，乳牙则用英文A～E分别代表如中切牙至第二乳磨牙。掌握“牙的组成、分类、功能及牙位记录”知识点。